采用三叉神经感觉功能判断半月神经节射频温控热凝术时，下列情况可达到最佳加热效果的是
A. 痛觉、触觉消失，角膜反射保留
B. 痛觉、触觉、角膜反射均消失
C. 痛觉、触觉消失，味觉保留
D. 痛觉消失，触觉、角膜反射保留
E. 痛觉、味觉消失，触觉保留

正确答案：D。痛觉消失，触觉、角膜反射保留

解析：半月神经节射频温控热凝术是有选择地破坏半月神经节内传导痛觉的纤维。掌握“三叉神经痛”知识点。